反映左、右心房电除极的是
A. P波
B. P-R段
C. QRS波群
D. ST段
E. T波

正确答案：A。P波

解析：P波（A对）为心房除极波，反映左、右心房除极过程中的电位和时间变化。P-R段（B错）指从P波的起点至QRS波群的起点，主要反映心房复极过程及电激动过程在房室交界区，以及其后所产生的微弱电位变化，一般呈零电位而显示为等电位线。QRS波群（C错）代表心室肌除极的电位和时间变化。ST段（D错）自QRS波群的终点至T波起点间的线段，代表心室缓慢复极过程的电位和时间变化。T波（E错）为心室复极波，代表心室快速复极时的电位和时间变化。